孕妇在整个孕期应该接受产前检查的次数是
A. 1次
B. 2～3次
C. 3～4次
D. 4～5次
E. 5次及以上

正确答案：E。5次及以上

解析：本题考查孕期产前检查的次数。孕期应进行5次以上（E对ABCD错）检查，孕早期至少进行1次，孕中期至少2次，孕晚期至少2次（其中至少1次在36周后进行），发现异常应增加检查次数。